疫源地消灭的条件
A. 外环境中的病原体已经被彻底清除
B. 传染源被移走
C. 全部易感者经该病的最长潜伏期观察均未发病或感染
D. A+B+C
E. 上述均错

正确答案：D。A+B+C